关于国家基本药物目录的说法，错误的是
A. 目录中的中成药成分中的“麝香”为人工麝香
B. 目录中的“安宫牛黄丸”成分中的“牛黄”为人工牛黄
C. 含有国家濒危野生动植物药材的药品不纳入目录遴选范围
D. 目录中化学药品未标明酸根或盐基的，其主要化学成分相同而酸根或盐基不同的均为目录的药品

正确答案：B。目录中的“安宫牛黄丸”成分中的“牛黄”为人工牛黄

解析：本题考查的是国家基本药物目录。国家基本药物目录中“安宫牛黄丸”和“活心丸”成分中的“牛黄”为天然牛黄、体内培植牛黄或体外培育牛黄（B错，为本题正确答案）。中成药成分中的“麝香”为人工麝香（A对），“牛黄”为人工牛黄，有“注释”的除外。目录中“安宫牛黄丸”和“活心丸”成分中的“牛黄”为天然牛黄、体内培植牛黄或体外培育牛黄。下列药品不纳入国家基本药物目录遴选范围：①含有国家濒危野生动植物药材的（C对）；②主要用于滋补保健作用，易滥用的；③非临床治疗首选的；④因严重不良反应，国家药品监督管理部门明确规定暂停生产、销售或使用的；⑤违背国家法律、法规，或不符合伦理要求的；⑥国家基本药物工作委员会规定的其他情况。国家基本药物目录中化学药品未标明酸根或盐基的，其主要化学成分相同而酸根或盐基不同的均为目录的药品（D对），2002年考试指南未明确说明。